男，70岁。70%烧伤第2日，收缩压：80mmHg，呼吸率34次/分，每小时平均尿量18ml，有黑色大便，血胆红素36μmol/L，血小板40×10⁹/L。Glasgow计分：5分。目前最恰当的诊断是
A. ARDS
B. ARF
C. DIC
D. ATN
E. MSOF

正确答案：E。MSOF

解析：老年男性患者。70%烧伤第2日（特重烧伤第2天，易发生休克及多脏器衰竭），收缩压：80mmHg（正常值120mmHg，提示患者已出现休克），呼吸率34次/分（正常值12～20次/分，提示患者可能出现肺部并发症），每小时平均尿量18ml（正常值40～80ml，提示肾功能不全，肾脏血流灌注不足），有黑色大便（提示消化道可能存在出血），血胆红素36μmol／L（正常值4～19μmol／L，提示肝脏或胆囊出现脏器功能衰竭），血小板40×10⁹（正常值100～300×10⁹，提示出现凝血功能障碍），Glasgow计分：5分（格拉斯哥昏迷评分法，最高15分，表示意识清醒，8分以下为昏迷，最低3分，分数越低表明意识障碍越严重，脑死亡或预后极差，目前最恰当的诊断是多系统器官功能衰竭即MSOF（E对）。ARDS（A错）即急性呼吸窘迫综合症，主要表现为呼吸窘迫、顽固性低氧血症和呼吸衰竭，题干中只指出患者呼吸速率加快，并不足以诊断为ARDS；ARF（B错）和ATN（D错）分别为急性肾功能衰竭和急性肾小管损伤，患者每小时平均尿量减少，提示存在肾血流灌注不足，可能存在肾功能不全，但并不能概括患者出现的其他症状，属于漏诊；DIC（C错）即弥散性血管内凝血，血小板计数40×10⁹只能提示患者出现明显凝血功能障碍，但不能确诊患者已出现DIC；且不能概括患者出现的其他症状，亦属于漏诊。